豆类食物可与谷类食物混合食用而提高谷类蛋白的营养价值，是因为豆类食物中富含
A. 蛋氨酸
B. 赖氨酸
C. 苏氨酸
D. 色氨酸
E. 亮氨酸

正确答案：B。赖氨酸